属于氧青霉烷类的β-内酰胺类抗生素是
A. 氨曲南
B. 亚胺培南
C. 舒巴坦钠
D. 克拉维酸钾
E. 替莫西林

正确答案：D。克拉维酸钾

解析：本题考查氧青霉烷类抗菌药。属于氧青霉烷类的β-内酰胺类抗生素是克拉维酸（D对）。氨曲南（A错）属于单环β-内酰胺类。亚胺培南（B错）属于碳青霉烯类。舒巴坦钠（C错）属于青霉烷砜类。替莫西林（E错）属于半合成青霉素。